以下哪组反映了学校健康教育形式的架构
A. 教学、活动、环境
B. 教学、服务、环境
C. 教学、服务、活动
D. 教学、活动、政第
E. 教学、服务、政策

正确答案：B。教学、服务、环境